右心房的结构，描述不正确的是
A. 是接受肺循环血液回流的心腔
B. 入口为上、下腔静脉口和冠状窦口
C. 出口为右房室口
D. 血栓脱落后首先被栓塞的器官是肺
E. 分为固有心房和腔静脉窦

正确答案：A。是接受肺循环血液回流的心腔

解析：右心房是接受体循环（A错，为本题正确答案）血液回流的心腔。入口为上、下腔静脉口和冠状窦口（B对）。出口为右房室口（C对）。右心房血栓脱落后经过肺循环，首先被栓塞的器官是肺（D对）。右心房分为固有心房和腔静脉窦（E对）。